心室在单位压力变化下所引起容积改变的倒数，称为
A. 紧张性扩张
B. 肌源性扩张
C. 向心性肥大
D. 心室僵硬度
E. 心肌重构

正确答案：D。心室僵硬度

解析：心室顺应性是指心室在单位压力变化下所引起的容积改变，其倒数即为心室僵硬度（D对）。